我国成人维生素C的RNI值为
A. 60mg/d
B. 70mg/d
C. 80mg/d
D. 90mg/d
E. 100mg/d

正确答案：E。100mg/d